女，55岁。早上小便后用纸擦见纸上都是血。诉就诊前一天去某养生院按摩，按摩师在给腰部按摩时特别用力，按摩后自我感觉腰部疼痛。检查：血常规正常，尿+++/HP。B超提示：肾增大，肾破裂，CT诊断一致。首选的治疗措施是
A. 血肿去除手术
B. 肾部分切除
C. 肾切除
D. 介入治疗
E. 观察

正确答案：D。介入治疗

解析：55岁女性患者（肾错构瘤高发人群），1天前腰部受外力后疼痛，晨起血尿就诊（外力导致肿瘤内部出血），检查血常规正常，尿红细胞+++/HP(血尿），影像学提示肾脏增大，肾脏破裂，根据患者的发病诱因、临床表现、实验室检查和影像学检查结果，最可能的诊断是肾错构瘤（肾血管平滑肌脂肪瘤），根据患者的临床基本情况，首选的治疗措施是介入治疗，即行肾动脉栓塞止血（D对E错）。对错构瘤行肾切除术必须慎重，需尽可能保留肾功能，手术指征为：全肾侵犯；肿瘤生长快，可疑恶性；不能控制的危及生命的出血，本例可暂不行肾切除手术（BC错）。血肿去除手术不作为肾错构瘤的常规治疗（A错）。